氯气含量达到多少时，人们会感到呼吸困难、脉搏迟缓、血压下降，甚至休克死亡
A. 1×10⁻⁶mg/m³
B. 5×10⁻⁶mg/m³
C. 10×10⁻⁶mg/m³
D. 50×10⁻⁶mg/m³
E. 100×10⁻⁶mg/m³

正确答案：E。100×10⁻⁶mg/m³

解析：本题考查氯气含量。含氯消毒剂与含酸洗涤剂混合使用时产生的氯气，会引起氯气中毒，将严重损害人体健康。当空气中氯气含量达到100×10⁻⁶mg/m³时（E对ABCD错），人们会出现呼吸困难、脉搏迟缓、血压下降，甚至休克、死亡。